男，70岁，阵发性胸痛5年余。症状发作时可于心尖部闻及3/6级收缩期吹风样杂音，症状缓解杂音消失。产生此杂音的最可能原因是
A. 乳头肌功能不全
B. 合并风湿性心瓣膜病
C. 腱索断裂
D. 二尖瓣环扩张
E. 合并退行性心瓣膜病

正确答案：A。乳头肌功能不全

解析：患者老年男性，阵发性胸痛5年余，听诊可闻及心尖部3/6级收缩期吹风样杂音症状缓解杂音消失。根据患者症状最可能为二尖瓣关闭不全。由于患者病状为阵发性，因此较可能为乳头肌缺血导致的功能不全引起的二尖瓣关闭不全（A对CE错）。风湿性心脏瓣膜病常引起二尖瓣狭窄或腱索断裂（B错）。二尖瓣环扩大常累及传导系统，引起不同程度的房室或室内传导阻滞（D错）。